不属于甲肝病毒特点的是
A. 属于无包膜小RNA病毒
B. 主要经粪-口传播
C. 预后不良可诱发肝癌
D. 病后可获持久免疫
E. 可用灭活或减毒活疫苗预防

正确答案：C。预后不良可诱发肝癌

解析：HAV经口及肠道侵入人体，最终定位于主要靶器官肝脏，引起肝损伤。甲型肝炎患者预后良好。不会转变为慢性，亦无病毒携带者。掌握“甲型肝炎病毒”知识点。